保存蔬菜水果最适宜的温度约为
A. -20℃
B. -4℃
C. 0～2℃
D. 2～4℃
E. 20℃

正确答案：C。0～2℃